骨盆对角径的正常值为
A. 9cm
B. 10cm
C. 11cm
D. 12cm
E. 13cm

正确答案：E。13cm

解析：骨盆对角径的正常值12.5-13cm（E对）。